嵌插骨折的主要诊断根据是
A. 骨折部的压痛和轴向叩击痛
B. 骨折部的反常活动
C. 骨折部软组织肿胀和瘀斑
D. 骨折部畸形
E. 骨折部的骨擦音和骨擦感

正确答案：A。骨折部的压痛和轴向叩击痛